下列关于引流部位的描述中，正确的是
A. 开放引流的引流物内端应放置在创口内深处
B. 引流口的大小要适当，太小引流不畅
C. 开放引流的引流物外端则应依体位放在创口最低处
D. 负压引流管应避免放在重要血管、神经的附近，其戳创口应封闭
E. 以上均正确

正确答案：E。以上均正确

解析：引流部位：开放引流的引流物内端应放置在创口内深处，其外端则应依体位放在创口最低处，以利重力引流。负压引流管应避免放在重要血管、神经的附近，其戳创口也应封闭，才能收到负压效应。引流口的大小要适当，太小引流不畅；太大，将在引流部位形成粗大瘢痕。掌握“口外手术打结、缝合及外科引流”知识点。